婴儿腹泻进行补液时，兼有扩充血容量及纠正酸中毒的最合适的溶液是
A. 2：3：1溶液
B. 1.4%的碳酸氢钠
C. 5%的碳酸氢钠
D. 11.2%的乳酸纳
E. 5%的生理盐水

正确答案：B。1.4%的碳酸氢钠

解析：进行扩容治疗时应首先选用等张的2：1含钠液（2份0.9%NaCl溶液配1份1.4%NaHCO₃溶液），由于此溶液含有HCO₃⁻离子，因此可以纠正酸中毒（B对）。2：3：1液为1/2张含钠液，一般用于等渗性脱水的第一阶段累计损失量补充及各种脱水的第二阶段继续丢失量补充（A错）。5%NaHCO₃溶液仅用于纠酸（C错）。11.2%的乳酸钠溶液仅用于扩容（D错）。5%的生理盐水属于高渗液，在补液时仅用于成人低渗性脱水（E错）。